用于治疗慢性丙肝的药物是
A. 恩替卡韦
B. 伐昔洛韦
C. 索磷布韦
D. 利托那韦
E. 奥司他韦

正确答案：C。索磷布韦

解析：本题考查索磷布韦的适应症。索磷布韦维帕他韦（C对）可用于治疗成人慢性丙型肝炎病毒（HCV）感染。